属于腧穴特殊作用的是
A. 合谷治疗五官病
B. 听宫治疗耳鸣
C. 睛明治疗眼病
D. 下脘治疗胃病
E. 大椎退热

正确答案：E。大椎退热

解析：腧穴的主治特点：①近治作用，是指腧穴具有治疗其所在部位局部及邻近组织、器官病证的作用。听宫位于耳区可治疗耳鸣、睛明位于眼区可治疗眼病、下脘位于胃脘部周围可治疗胃病，这些均属于腧穴的近治作用（BCD错）。②远治作用，是指腧穴具有治疗其远隔部位的脏腑、组织器官病证的作用。合谷可以治疗本经所经过的五官部位病证，属于腧穴的远治作用（A错）。③特殊作用，是指有些腧穴具有双向良性调整作用和相对特异的治疗作用；大椎退热是腧穴治疗的特异性，属于特殊作用（E对）。腧穴的主治规律：①分经主治，是指某一经脉所属的经穴均可治疗该经循行部位及其相应脏腑的病证。②分部主治，是指处于身体某一部位的腧穴均可治疗该部位及某类病证。